少女青春期月经来潮
A. 影响血液循环
B. 易贫血，对健康不利
C. 是正常的生理现象
D. 影响体格发育
E. 影响心肺功能

正确答案：C。是正常的生理现象